某病人，13岁。在生活中养成不良的抽烟习惯，父母非常恼火，心理医师建议其采取的较有效地行为治疗是
A. 条件刺激和非条件刺激相结合
B. 环境因素和操作动作相结合
C. 厌恶刺激与不良行为相结合
D. 通过对不良行为的认识来矫正
E. 用转变注意力的方法来矫正

正确答案：C。厌恶刺激与不良行为相结合